患者肩背疼不可回顾，头痛身重，腰脊疼痛，舌苔白，脉浮。治疗应选用
A. 独活寄生汤
B. 三仁汤
C. 小青龙汤
D. 羌活胜湿汤
E. 麻黄汤

正确答案：D。羌活胜湿汤

解析：患者肩背疼不可回顾，头痛身重，腰脊疼痛，舌苔白，脉浮。多由汗出当风，或久居湿地，风湿之邪侵袭肌表所致。为风湿在表证，方用羌活胜湿汤，常用祛风胜湿止痛。羌活、独活祛风胜湿，通利关节，防风、藁本祛风胜是，止头痛。川芎活血行气，祛风止痛；蔓荆子祛风止痛，甘草调和诸药（D对）。独活寄生汤为治疗久痹而肝肾两虚，气血不足之常用方（A错）。三仁汤为治疗湿温初起，邪在气分，湿重于热的常用方剂（B错）。小青龙汤主治外感风寒，寒饮内停之证（C错）。麻黄汤证为外感风寒，肺气失宣所致。为外感风寒证的基础方（E错）。